用药咨询是执业药师应用所掌握的药学知识和药品信息，承接公众对药物治疗和合理用药的咨询服务。下列不属于患者用药咨询常见内容的是
A. 药品适应病证是否与患者病情相对应
B. 处方中是否存在配伍禁忌和证候禁忌
C. 药品的正确服法、服用时间及漏服补救法
D. 药品服用后的预计疗效、起效及维持时间
E. 中药注射液的溶媒、浓度及滴注速过

正确答案：E。中药注射液的溶媒、浓度及滴注速过

解析：本题考查患者用药咨询。下列不属于患者用药咨询常见内容的是中药注射液的溶媒、浓度及滴注速过（E错，为本题正确答案）。护士用药咨询：由于护理的工作特点决定了他们需要更多地获得有关药物的配伍、配伍禁忌、剂量、用法，注射剂配置溶媒、浓度和输液滴注速度，以及输液药物的稳定性和配伍的理化变化、药品的保管等信息。患者用药咨询（1）药品名称：包括通用名、商品名、别名。（2）适应病证：药品适应病证与患者病情相对应（A对）。（3）用药禁忌：包括配伍禁忌、妊娠禁忌、证候禁忌（B对）、饮食禁忌等。（4）用药方法：包括口服药品的正确服用方法、服用时间和用药前的特殊提示；栓剂、滴眼剂、气雾剂等外用剂型的正确使用方法；缓释制剂、控释制剂、肠溶制剂等特殊剂型的用法；如何避免漏服药物，以及漏服后的补救方法（C对）。（5）用药剂量：包括首次剂量、维持剂量；每日用药次数、间隔；疗程。（6）服药后预计疗效及起效时间、维持时间（D对）。（7）药品的不良反应与药物相互作用。（8）有否替代药物或其他疗法。（9）药品的鉴定辨识、贮存和有效期。（10）药品价格、报销，是否进入医疗保险报销目录等。